男，32岁。多次于饮酒后关节红肿疼痛发作，累及的关节包括第一跖趾关节、踝或膝关节。该患者最可能出现的结果是
A. 血HLA-B27（+）
B. 血尿酸水平升高
C. X线片示骶骨关节炎
D. 尿渗透压降低
E. 关节腔穿刺液呈脓性

正确答案：B。血尿酸水平升高

解析：患者青年男性（骨关节炎少发），多次于饮酒后关节红肿疼痛发作（饮酒为痛风诱因），累及的关节包括第一跖趾关节、踝或膝关节（痛风的关节表现以单侧第一跖趾关节最常见，其余为趾、踝、膝、腕、指、肘关节）。根据患者病史、临床表现，可以诊断为痛风，实验室检查主要有血尿酸的升高，正常成年男性血尿酸值约为3.5～7.0mg/dl，女性约为2.5～6.0mg/dl，男性和绝经后女性血尿酸＞7.0mg/dl，绝经前女性＞6.0mg/dl可诊断为高尿酸血症（B对）（P862）。血HLA-B27人类白细胞抗原，组织相容性复合体，用于自身免疫疾病的测定，血HLA-B27（+）表示存在自身免疫性疾病，痛风血HLA-B27（-）（A错）。骶骨关节炎好发于年长者，疼痛多发生于活动后，休息后可缓解，无饮酒的诱因（C错）（P857）。痛风患者尿尿酸生成增多，无渗透压变化（D错）。痛风的关节腔穿刺液中发现特异性尿酸盐结晶（E错）。